两种药物配伍容易形成白色沉淀的是
A. 头孢唑林钠与0.9%氯化钠注射液
B. 头孢曲松与复方氯化钠注射液
C. 胰岛素与0.9%氯化钠注射液
D. 青霉素与5%葡萄糖注射液
E. 维生素C与氯化钠注射液

正确答案：B。头孢曲松与复方氯化钠注射液

解析：本题考查药物的配伍使用。头孢曲松钠不能与含钙注射液（葡萄糖酸钙、氯化钙、复方氯化钠注射液（B对）、乳酸钠林格氏注射液、复方乳酸钠葡萄糖注射液、含钙的静脉营养液）直接混合，会导致微粒形成。青霉素含β-内酰胺环，酸性较强的葡萄糖注射液（A错）可促进青霉素裂解。头孢唑林钠（A错）、胰岛素（C错）、维生素C（E错）可以使用氯化钠做溶剂。